牙板上皮剩余或Serres上皮剩余可发生
A. 萌出囊肿
B. 牙龈囊肿
C. 残余囊肿
D. 根尖周囊肿
E. 炎性牙旁囊肿

正确答案：B。牙龈囊肿

解析：牙板上皮剩余或Serres上皮剩余可发生发育性根侧囊肿和牙龈囊肿。掌握“牙源性囊肿”知识点。